G蛋白游离的α亚基GTP
A. 使σ亚基与效应蛋白解高
B. 具蛋白激酶A活性
C. 具蛋白激酶C活性
D. 具酪氨酸蛋白激酶活性
E. 可激活腺苷酸环化酶

正确答案：E。可激活腺苷酸环化酶